男性，50岁，反复咳嗽、咳痰4年，近半年来发作时常伴呼吸困难。体检：双肺散在哮鸣音，肺底部有湿啰音。肺功能测定：一秒钟用力呼气容积/用力肺活量为55%，残气容积/肺总量为35%。诊断应考虑为
A. 慢性单纯型支气管炎
B. 慢性喘息性支气管炎
C. 支气管哮喘
D. 慢性支气管炎合并肺气肿
E. 支气管哮喘合并肺气肿

正确答案：B。慢性喘息性支气管炎

解析：患者为中老年男性，有慢性咳嗽、咳痰病史，呼吸困难逐渐加重，查体可闻双肺散在哮鸣音及肺底部湿啰音，起病缓慢，病程长，主要症状为咳嗽咳痰，伴有喘息呼吸困难等，可判断为慢性支气管炎，双肺散在哮鸣音，为喘息性支气管炎（B对）。肺功能测定一秒用力呼气容积/用力肺活量（即FEV₁/FVC）减小，说明有已经发展为慢性阻塞性肺疾病。残气容积/肺总量增大（注：临床上该数值大于40%才可诊断为肺气肿）（DE错）。支气管哮喘多在儿童或青少年期起病，以发作性喘息为特征，发作时两肺布满哮鸣音，常有家庭或个人过敏史，症状经治疗后可缓解或自行缓解，支气管哮喘的气流受限多为可逆性，其支气管舒张试验阳性（CE错）。